肝硬化最严重也是最常见的死亡原因为
A. 上消化道出血
B. 自发性腹膜炎
C. 肝肾综合征
D. 肝性脑病
E. 原发性肝癌

正确答案：D。肝性脑病

解析：肝性脑病（D对）是由严重肝病或门-体分流引起的、以代谢紊乱为基础、中枢神经系统功能失调的综合征，常见诱因有消化道出血、大量排钾利尿、放腹水及感染等，为肝硬化最严重的并发症和最常见的死亡原因。上消化道出血（A错）为肝硬化最常见的并发症，包括食管胃底静脉曲张出血、消化性溃疡和急性出血性糜烂性胃炎、门静脉高压性胃病。肝硬化可进展为原发性肝癌（E错），自发性腹膜炎（B错）为肝硬化感染并发症，但均不是肝硬化最主要致死原因。肝肾综合征（C错）是由于严重门静脉高压，内脏高动力循环使体循环血流量明显减少，肾脏血流灌注不足，出现肾衰竭，缓进型多见，肾衰竭病程缓慢，可在数月内保持稳定状态。